防止苯并（a）芘危害的措施是
A. 吸附法去除
B. 增加蔬菜水果的摄入量
C. 发展实用的检测方法
D. 防止食物被微生物污染
E. 施用钼肥

正确答案：A。吸附法去除